男，33岁。因上腹痛10个月来诊。伴有胃胀、食量减少，嗳气，睡眠差。检查X线钡餐造影、胃镜未见异常。患者为程序工程师，最近频繁超时工作。考虑为
A. 慢性浅表性胃炎
B. 慢性萎缩性胃炎
C. 功能性消化不良
D. 胃溃疡
E. 胃癌

正确答案：C。功能性消化不良

解析：患者腹痛10个月，伴有胃胀、食量减少，嗳气，睡眠差，检查X线钡餐造影、胃镜未见异常，因慢性浅表性胃炎（黏膜可充血水肿或黏膜皱襞肿胀增粗）（A错）、慢性萎缩性胃炎（黏膜色泽变淡，皱襞变细而平坦，黏液减少，黏膜变薄，有时可透见黏膜血管纹）（B错）、胃溃疡（D错）和胃癌（E错）在胃镜下皆可见异常，故不考虑，且患者为程序工程师，最近频繁超时工作，有精神的诱发因素，综上考虑诊断为功能性消化不良（C对）。